出生后一个10年内生长非常迅速并基本成熟的系统是
A. 心血管系统
B. 淋巴系统
C. 神经系统
D. 消化系统
E. 生殖系统

正确答案：B。淋巴系统